道德的评价标准是
A. 美与丑
B. 虚与实
C. 公与私
D. 善与恶
E. 人与物

正确答案：D。善与恶

解析：德行为也称“伦理行为”，是指在一定道德意识支配下表现出来的具有道德意义并能进行道德评价的行为，与“非道德行为”相对。道德行为分为道德的行为和不道德的行为。一般而言，道德的行为是指符合一定的道德原则和规范，有利于他人和社会的行为，常被称为“善行”。反之，违背一定的道德原则和规范，有害于社会和他人的行为，则为不道德的行为，常被称为“恶行”。对道德行为的判断是一个复杂的过程，需根据行为者的动机、目的及行为的效果，综合各方面对行为的善恶做出评价（D对）。